按照全面深化行政审批制度改革，进一步简政放权的精神，国家分批取消或调整了一部分与药品相关的行政审批事项，下列项目属于未被取消审批的事项是
A. 药品委托生产许可
B. 中药材GAP认证
C. 药品零售企业GSP认证
D. 互联网药品交易服务企业审批

正确答案：A。药品委托生产许可

解析：本题考查的是药品行政许可事项。按照全面深化行政审批制度改革，进一步简政放权的精神，国家分批取消或调整了一部分与药品相关的行政审批事项，下列项目属于未被取消审批的事项是药品委托生产许可（A对）。按照全面深化行政审批制度改革，进一步简政放权的精神，在药品监管领域中，近些年分批分次全部取消了非行政事项，取消了一部分与药品相关的行政事项，如新药试行标准转正，蛋白同化制剂、肽类激素境外委托生产备案，基本医疗保险定点零售药店资格审查、基本医疗保险定点医疗机构资格审查等。同时，将药品委托生产行政许可，生产第一类中的药品类易制毒化学品，蛋白同化制剂、肽类激素进口准许证核发，麻醉药品、第一类精神药品和第二类精神药品原料药定点生产等行政项目由原食品药品监管总局下放至省级人民政府食品药品监管部门。国务院印发《关于取消13项国务院部门行政许可事项的决定》（国发〔2016〕10号），规定取消中药材生产质量管理规范（GAP）认证（B错）。2017年1月12日，《国务院关于第三批取消中央指定地方实施行政许可事项的决定》（国发〔2017〕7号）发布，决定取消了39项中央指定地方实施的行政许可事项。其中，取消省级食品药品监督管理部门对互联网药品交易服务企业（第三方平台除外）审批（D错），要求食品药品监督管理部门在取消审批后，强化“药品生产企业许可”“药品批发企业许可”“药品零售企业许可”，对互联网药品交易服务企业严格把关。根据国家药品监督管理局发布的《关于贯彻实施〈中华人民共和国药品管理法〉有关事项的公告》（2019年第103号）：自2019年12月1日起，取消药品GMP、GSP认证（C错），不再受理GMP、GSP认证申请，不再发放药品GMP、GSP证书。